科研用血是否需要审批
A. 需要
B. 不需要
C. 自找血源
D. 收集病人血样
E. 亲属血样

正确答案：A。需要

解析：医疗机构科研用血由所在地省级卫生行政部门负责核准。掌握“医疗机构临床用血管理、及法律责任”知识点。